关于尺动脉的描述，错误的是
A. 为肱动脉终支之一
B. 经尺侧腕屈肌深面的桡侧下行
C. 在腕前部位于腕豆骨尺侧
D. 经腕横韧带浅面入手掌
E. 两侧有同名静脉伴行

正确答案：C。在腕前部位于腕豆骨尺侧

解析：肱动脉终支（A对）为桡动脉和尺动脉。经尺侧腕屈肌深面的桡侧下行（B对）。在腕前部位于腕豆骨桡侧（C错，为本题正确答案）。经腕横韧带浅面入手掌（D对）。两侧有同名静脉伴行（E对）。